可能引起肠肝循环的排泄过程是
A. 肾小管分泌
B. 肾小球滤过
C. 肾小管重吸收
D. 胆汁排泄
E. 乳汁排泄

正确答案：D。胆汁排泄

解析：本题考查药物的排泄。胆汁排泄（D对）可以引起肠肝循环，肠-肝循环是指随胆汁排入十二指肠的药物或其它代谢物，在肠道中又重新被吸收，经门静脉返回肝脏，重新进入血液循环的现象；肾小管分泌（A错）主要发生在近曲小管；肾小球滤过（B错）是血液流经肾小球发生的作用；非解离型的弱酸性药物和弱碱性药物在肾脏远曲小管可经过简单扩散而被重吸收（C错）；乳汁排泄（E错）：大多数药物能从乳汁排出，一般药物在乳汁中的浓度低，但是有些药物从乳汁排出较多。